米帕明主要用于
A. 抑郁症
B. 躁狂症
C. 晕动病
D. 精神分裂症
E. 重症肌无力

正确答案：A。抑郁症

解析：丙米嗪又称米帕明。用于各种原因引起的抑郁症，对内源性抑郁症、更年期抑郁症效果较好。对反应性抑郁症次之，对精神病的抑郁成分效果较差。此外，抗抑郁药也可用于强迫症的治疗。掌握“丙米嗪、碳酸锂、氟西汀”知识点。